躯干、四肢浅感觉传导通路的交叉部位在
A. 脊髓外侧索内
B. 斜方体
C. 延髓中央灰质腹侧
D. 锥体交叉
E. 脊髓白质前连合

正确答案：E。脊髓白质前连合

解析：躯干、四肢浅感觉传导通路，即痛温觉、粗触觉和压觉传导通路，脊髓丘脑侧束主要传递痛、温觉信息，脊髓丘脑前束主要传递粗触觉、压觉信息，脊髓丘脑束主要起自脊髓灰质I和IV～VIII层，纤维经脊髓白质前连合（E对）交叉至对侧时上升,或先上升后再经脊髓白质前连合。